某女，40岁。呃逆、嗳气1周余。因与家人吵架生气后，呃声不断，嗳气则舒，胃脘痞塞，时有嘈杂反酸，急躁易怒，多梦，大便不畅，舌红，苔薄黄腻，脉弦。既往史：乙型肝炎5年，十二指肠溃疡2年。医师处方如下：旋覆花9g，吴茱萸5g，黄连5g，枳实9g，紫苏梗10g，香附10g，陈皮10g，竹茹10g，甘草9g，7剂，水煎服，每日1剂，早、晚分服。患者服药后，呃逆频次减少，胃脘痞塞减轻，但仍嗳气反酸，食欲不振。自行到药店买药，要求购药21剂。执业药师告知患者，长期服用该处方存在风险，因其含有
A. 黄连
B. 吴茱萸
C. 旋覆花
D. 枳实
E. 香附

正确答案：B。吴茱萸

解析：本题考查的是中药饮片的不良反应。呃逆、嗳气1周余。因与家人吵架生气后，呃声不断，嗳气则舒，胃脘痞塞，时有嘈杂反酸，急躁易怒，多梦，大便不畅，舌红，苔薄黄腻，脉弦。既往史：乙型肝炎5年，十二指肠溃疡2年。医师处方如下：旋覆花9g，吴茱萸5g，黄连5g，枳实9g，紫苏梗10g，香附10g，陈皮10g，竹茹10g，甘草9g，7剂，水煎服，每日1剂，早、晚分服。患者服药后，呃逆频次减少，胃脘痞塞减轻，但仍嗳气反酸，食欲不振。自行到药店买药，要求购药21剂。执业药师告知患者，长期服用该处方存在风险，因其含有吴茱萸（B对）。吴茱萸的不良反应表现：腹痛、腹泻、视力障碍、错觉、脱发、胸闷、头痛、眩晕或皮疹、流产等症状。尽管临床尚无报道，但动物实验证实吴茱萸存在肝脏毒性，临床应用仍需警惕。